牙齿的磨耗随年龄的增长而逐渐明显，多发生在
A. （牙合）面、切嵴、邻面
B. （牙合）面、切嵴、唇面
C. （牙合）面、唇面、舌面
D. 切嵴、唇面、舌面
E. 切嵴、邻面、唇面

正确答案：A。（牙合）面、切嵴、邻面

解析：牙齿的磨耗随年龄的增长而逐渐明显，多发生在牙齿的（牙合）面、切嵴及邻面。掌握“牙动度和唇、舌、腭对咀嚼的作用”知识点。